柯萨奇病毒A组
A. 20个型
B. 21个型
C. 22个型
D. 23个型
E. 24个型

正确答案：E。24个型

解析：柯萨奇病毒和埃可病毒血清型别多，柯萨奇病毒分为A组24个型，B组6个型及埃可病毒31个型，与脊灰病毒；相比，在生物学性状、传播途径及致病机制等方面均相似，并均以隐性感染居多。掌握“胃肠道病毒”知识点。